男，64岁。巩膜黄染、尿色深黄2周。无腹痛、发热。查体：右上腹可触及肿大胆囊，无压痛。血总胆红素156μmol/L。最可能的诊断是
A. 急性肝炎
B. 壶腹周围癌
C. 胆总管结石
D. 慢性胰腺炎
E. 胆囊结石

正确答案：B。壶腹周围癌

解析：老年男性，巩膜黄染，血总胆红素156μmol/L（正常值为3.4～17.1μmol/L），右上腹可触及肿大胆囊，无压痛，（胆管癌常见黄疸，无痛性胆囊肿大）。综合患者的病史、体查、实验室检查，最可能的诊断是胆管癌，而壶腹周围癌中的胆总管下端癌属于胆管癌，所以选壶腹周围癌（B对）。急性肝炎（A错）一般有与肝炎患者密切接触史，血液、体液感染史，暴发流行区有水源、食物污染史等，常有发热、恶心、厌油、纳差、腹胀、便清、明显乏力等。胆总管结石（P440）（C错）属于肝外胆管结石，平时一般无症状或仅有上腹不适，当结石造成胆管梗阻时可出现腹痛或黄疸，如继发胆管炎时，可有较典型的Charcot三联征：腹痛、寒战高热、黄疸的临床表现。慢性胰腺炎（P461）（D错）腹痛最常见，患者无腹痛。胆囊结石（P439）（E错）主要的临床表现是胆绞痛、上腹隐痛和胆囊积液，患者无腹痛。